下列抗高血压药物中，哪一种药易引起刺激性干咳
A. 维拉帕米
B. 卡托普利
C. 氯沙坦
D. 硝苯地平
E. 普萘洛尔

正确答案：B。卡托普利

解析：卡托普利（B对）属于ACEI类抗高血压药，可引起肺血管床内缓激肽以及前列腺素等物质的聚集，引起刺激性干咳、血管神经性水肿，一般停药后即可自行恢复。维拉帕米（A错）属于钙拮抗药，临床用于治疗室上性和房室结折返引起的心律失常，对急性心肌梗死、心肌缺血及强心苷中毒引起的室性早搏有效，为阵发性室上性心动过速治疗的首选药，口服较安全，可出现便秘、腹胀、头痛等不良反应，注射过快可引起心动过缓、房室传导阻滞，也可引起血压下降，诱发心力衰竭。氯沙坦（C错）是第一个用于临床的AT1受体阻断药，能竞争性阻断AngⅡ与AT1受体结合，从而拮抗AngⅡ的缩血管作用及增强交感神经活性的作用，临床用于各型高血压以及慢性心功能不全，偶有头晕、高血钾和体位性低血压等不良反应。硝苯地平（D错）高血压，对高血压伴心绞痛、糖尿病属于钙拮抗药，可用于轻、中、重各型高血压，对高血压伴有心绞痛、糖尿病、脑血管病、肾功能不良等并发症疗效较好，主要的不良反应有面部潮红，头痛、头晕、心悸等。普萘洛尔（E错）属于β受体阻断药，能够抗心绞痛、抗心律失常，同时还有良好的抗高血压作用，长期用药可收缩支气管平滑肌和血管平滑肌，伴有支气管哮喘、外周血管痉挛性疾病患者慎用，但不引起刺激性干咳。